某男，4岁。2日来，发热、恶风、微有汗出、咳嗽咯痰、咳喘气促。证属外感风热，宜选用的成药是
A. 小儿咳喘灵颗粒
B. 健脾康儿片
C. 解肌宁嗽丸
D. 肥儿丸
E. 鹭鸶咯丸

正确答案：A。小儿咳喘灵颗粒

解析：本题考查的是小儿咳喘灵颗粒的主治。外感风热，宜选用的成药是小儿咳喘灵颗粒（A对）。小儿咳喘灵颗粒【主治】小儿外感风热所致的感冒、咳喘，症见发热、恶风、微有汗出、咳嗽咯痰、咳喘气促；上呼吸道感染、支气管炎、肺炎见上述证候者。健脾康儿片（B错）【主治】脾胃气虚所致的泄泻，症见腹胀便泻、面黄肌瘦、食少倦怠、小便短少。解肌宁嗽丸（C错）【主治】外感风寒、痰浊阻肺所致的小儿感冒发热、咳嗽痰多。肥儿丸（D错）【主治】小儿消化不良，虫积腹痛，面黄肌瘦，食少腹胀泄泻。鹭鸶咯丸（E错）【主治】痰浊阻肺所致的顿咳、咳嗽，症见咳嗽阵作、痰鸣气促、咽干声哑；百日咳见上述证候者。